普萘洛尔诱发或加重支气管哮喘的主要原因是
A. 促进肥大细胞释放组胺
B. 直接兴奋支气管平滑肌
C. 阻断支气管平滑肌β₂受体
D. 兴奋平滑肌M受体
E. 阻断支气管平滑肌β₁受体

正确答案：C。阻断支气管平滑肌β₂受体